先天性遗传性的发育不全是
A. 先天性梅毒牙
B. 牙本质异常
C. 牙釉质发育不全
D. 牙骨质发育不全
E. 待回忆

正确答案：B。牙本质异常

解析：本题考查先天性遗传性发育不全的疾病。先天性遗传性的发育不全是牙本质异常（B对）。先天性梅毒牙（A错）的形成是由于在牙发育期，牙囊受到梅毒螺旋体感染，导致牙囊的慢性炎症和纤维化，发育中的牙受到压迫，成釉细胞扭曲。牙釉质发育不全（C错）的病因包括局部因素和全身因素，临床分为形成不全和矿化不全。牙骨质发育不全（D错）较少见。在锁骨颅骨发育无细胞性牙骨质沉积后，细胞性牙骨质缺失。牙骨质发育不全还可见于低磷酸酯酶症，为一种常染色体隐性疾病。